可引起先天性耳聋的病毒是
A. 呼吸道合胞病毒
B. 风疹病毒
C. 腮腺炎病毒
D. 腺病毒
E. 麻疹病毒

正确答案：B。风疹病毒

解析：风疹病毒可引起先天性耳聋（B对）。新生儿感染性肺炎的产后感染常见病原体有呼吸道合胞病毒（A错），腺病毒（D错）等。主要临床表现在于呼吸系统（八年制二版儿科学P129）。腮腺炎病毒（C错）引起的流行性腮腺炎，其临床特征为腮腺（包括颌下腺和舌下腺）的非化脓性肿胀、疼痛和发热，并由累及各种腺体及其他器官的可能（八年制二版儿科学P200）。麻疹病毒（E错）可传播至全身组织器官，但以口、呼吸道、眼结合膜、皮肤及胃肠道等部位为主，并表现出一系列的临床症状和体征（八年制二版儿科学P195）。